氯丙嗪主要用于
A. 抑郁症
B. 躁狂症
C. 晕动病
D. 精神分裂症
E. 重症肌无力

正确答案：D。精神分裂症

解析：氯丙嗪主要用于Ⅰ型精神分裂症（精神运动性兴奋和幻觉妄想为主）的治疗，尤其对急性患者效果显著，对慢性精神分裂症患者疗效较差。掌握“丙米嗪、碳酸锂、氟西汀”知识点。